某男，30岁。患肺热咳嗽，咯痰不爽1周，近日突发风热痒疹。宜选用的药是
A. 地肤子
B. 蔓荆子
C. 木贼
D. 蝉蜕
E. 牛蒡子

正确答案：E。牛蒡子

解析：本题考查的是牛蒡子的主治病证。患肺热咳嗽，咯痰不爽1周，近日突发风热痒疹。宜选用的药是牛蒡子（E对）。牛蒡子：【主治病证】（1）风热感冒，温病初起。（2）风热或肺热咳嗽、咯痰不畅，咽喉肿痛。（3）麻疹不透，风热疹痒。（4）热毒疮肿，痄腮。地肤子（A错）：【主治病证】（1）热淋。（2）风疹，湿疹，阴痒，湿疮。蔓荆子（B错）：【主治病证】（1）风热头痛、头昏，牙痛。（2）风热目赤肿痛或目昏多泪。（3）风湿痹痛，肢体拘急。木贼（C错）：【主治病证】（1）风热目赤，迎风流泪，翳障。（2）血热下血。蝉蜕（D错）：【主治病证】（1）风热感冒，温病初起，音哑咽痛。（2）麻疹不透，风疹瘙痒。（3）风热或肝热之目赤翳障。（4）小儿惊哭夜啼，破伤风。